对某男性患者进行胸部听诊，发现其肺部呼吸音声似“ha”音、音强、调高、吸气时弱而短，呼气时强而长。考虑为
A. 正常肺泡吸音
B. 正常支气管呼吸音
C. 支气管肺泡呼吸音
D. 肺泡呼吸音，呼吸时间延长
E. 支气管呼吸音，呼吸时间延长

正确答案：B。正常支气管呼吸音

解析：正常支气管呼吸音（B对）为吸入的空气在声门、气管或主支气管形成湍流所产生的声音，颇似抬舌后经口腔呼气时所发出“ha”的声响，该呼吸音强而高调，吸气相较呼气相短，因吸气为主动运动，吸气时声门增宽，进气较快；而呼气为被动运动，声门较窄，出气较慢之故。且呼气音较吸气音强而高调，吸气末与呼气始之间有极短暂的间隙。正常肺泡呼吸音（A错）是由于空气在细支气管和肺泡内进出移动的结果。吸气时气流经支气管进入肺泡，冲击肺泡壁，使肺泡由松弛变为紧张，呼气时肺泡由紧张变为松弛，从而形成肺泡呼吸音，是一种叹息样的柔和吹风样的“fu-f”声，其音调相对较低。支气管肺泡呼吸音（C错）为兼有支气管呼吸音和肺泡呼吸音特点的混合性呼吸音。其吸气音的性质与正常的肺泡呼吸应相似，但音调较高而且较响亮。其呼气音的性质与支气管呼吸音相似，但强度稍弱，音调稍低。